主要用于厌氧菌感染，对金黄色葡萄球菌引起的骨髓炎为首选的药物是
A. 红霉素
B. 青霉素
C. 庆大霉素
D. 多西环素
E. 林可霉素

正确答案：E。林可霉素

解析：林可霉素主要用于厌氧菌引起的感染，对金黄色葡萄球菌引起的骨髓炎为首选药物。掌握“红霉素及林可霉素”知识点。